食品中可被微生物利用的水是
A. 总水分
B. 结合水
C. 游离水
D. 可蒸发水
E. 可流动水

正确答案：C。游离水

解析：本题考查食品中可被微生物利用的水。食品中的水分以游离水和结合水两种形式存在，其中游离水（C对ABDE错）是指食品中与非水成分有较弱作用或基本没有作用的水，是可被微生物利用的水。